关于肠外营养能量配比的说法正确的有
A. 葡萄糖和脂肪乳剂是提供热量的主要物质
B. 1g葡萄糖提供5kcal热量
C. 1g脂肪提供8kcal热量
D. 蛋白质(氨基酸）不是主要的供能物质
E. 一般成人热量需求为每天15～20kcal/kg

正确答案：A、D。葡萄糖和脂肪乳剂是提供热量的主要物质；蛋白质(氨基酸）不是主要的供能物质

解析：本题考查肠外营养能量配比。肠外营养物质主要为糖、脂肪、氨基酸、电解质、维生素、微量元素（A对）。蛋白质不是主要的供能物质（D对）。1g葡萄糖提供4kcal热量（B错）；1g脂肪提供9kcal热量（C错）；1g氮提供4kcal热量。